患儿，女，10岁。阵发性右上腹绞痛，伴恶心、呕吐，腹部平软。用特定穴治疗，应首选
A. 原穴
B. 络穴
C. 背俞穴
D. 郄穴
E. 下合穴

正确答案：D。郄穴

解析：患儿阵发性右上腹绞痛，伴恶心、呕吐，腹部平软为急性痛证，而阳经郄穴多用来治疗急性痛证，阴经郄穴常用治疗血证，如急性胃病用梁丘，咯血用孔最（D对）。原穴（P195-P196）主要用于治疗相关脏腑的疾病，也可协助诊断（A错）。络穴（P196）是络脉从本经别出的部位，络穴除可治疗其络脉的病症外…扩大了经脉的主治范围（B错）。背俞穴（P196）和募穴都是脏腑之气输注和汇聚的部位…治疗相关脏腑的病变（C错）。下合穴（P198）主要用于治疗六腑疾病（E错）。